人造冠就位的标志是
A. 边缘密合
B. 无翘动
C. 咬合基本良好
D. A+B
E. A+B+C

正确答案：E。A+B+C

解析：冠就位的标志①冠的龈边缘到达设计的位置，有肩台预备的颈缘应与冠边缘密合无明显缝隙。②制备良好的人造冠就位后，咬合应基本合适，或稍加修整即合适。③人造冠在患牙上就位后不出现翘动现象。掌握“修复体试戴、磨光与粘固”知识点。